联合国的千年发展目标中不包括在1990年的基础上
A. 将5岁以下儿童死亡率降低三分之二
B. 将婴儿死亡率降低三分之二
C. 将产妇死亡率降低四分之三
D. 将无法获得安全饮用水的人口比例减半
E. 遏止并开始扭转疟疾的发病率增长

正确答案：B。将婴儿死亡率降低三分之二